参加新药Ⅱ期临床试验的对象应该是
A. 18～40岁健康志愿者
B. 18～65岁目标适应证患者
C. 16～l8岁健康志愿者
D. 12～30岁女性健康志愿者
E. 12～70岁目标适应证患者

正确答案：B。18～65岁目标适应证患者

解析：本题考查新药临床评价的分期。新药Ⅱ期临床试验的对象为18-65岁目标适应证患者（B对），且不少于300例，其中主要病种不少于100例，要求多中心即在3个及3个以上医院进行。Ⅱ期临床试验是治疗作用的初步评价阶段。初步评价药物对目标适应证患者的治疗作用和安全性，为Ⅲ期临床试验研究的设计和给药剂量方案的确定提供依据。